亚硫酸钠在注射液中用作
A. 抗氧剂
B. 抑菌剂
C. 止痛剂
D. 渗透压的调节剂
E. pH调节剂

正确答案：A。抗氧剂

解析：本题考查的是注射剂的附加剂。亚硫酸钠在注射液中用作抗氧剂（A对）。注射剂的抗氧剂：常用的抗氧剂有亚硫酸钠、亚硫酸氢钠和焦亚硫酸钠等，一般浓度为0.1%～0.2%。注射剂的抑菌剂（B错）：常用抑菌剂为0.5%苯酚、0.3%甲酚、0.5%三氯叔丁醇、0.01%硫柳汞等。注射剂的止痛剂（C错）：常用的止痛剂有三氯叔丁醇、盐酸普鲁卡因、盐酸利多卡因等。注射剂的调节渗透压的附加剂（D错）：常用的有氯化钠、葡萄糖等。注射剂的调节pH的附加剂（E错）：常用的调节pH的附加剂有盐酸、枸橼酸、氢氧化钠、氢氧化钾、碳酸氢钠、磷酸氢二钠、磷酸二氢钠等。